临床试验中采用双盲法是为了控制
A. 选择偏倚
B. 信息偏倚
C. 混杂偏倚
D. 入院偏倚
E. 回忆偏倚

正确答案：B。信息偏倚

解析：本题考查双盲的作用。双盲法主要是控制来自受试对象和研究人员主观因素对实验结果的影响，目的是避免在收集信息的过程中主观因素造成的偏倚，因此属于信息偏倚（B对ACDE错）。